治疗肾阳不足阳痿，应选用
A. 丁香
B. 细辛
C. 花椒
D. 小茴香
E. 高良姜

正确答案：A。丁香

解析：丁香辛香温散沉降，药力较强。入脾、胃经，善温中降逆，治中寒呃逆。入肾经，能温肾助阳，治肾阳虚诸证。肾阳虚多见形寒肢冷，精神不振，腰膝酸软，或阳痿不举（A对）。细辛（B错）芳香气浓，辛温走窜，入心、肺、肾经，通彻表里上下，有小毒而力较强。善祛风散寒、通窍止痛，为治风寒、风湿所致诸痛及鼻渊鼻塞头痛之良药。能温散肺寒、化痰饮，为治寒饮伏肺之要药。最宜少阴头痛、鼻渊与牙痛。花椒（C错）辛热燥散，入脾、胃、肾经，有小毒而力较强。善温中散寒而止痛，并兼燥湿，治中寒腹痛吐泻；能杀虫，治虫积腹痛及湿疹阴痒。小茴香（D错）辛香温散，药力稍缓。入肝、肾经，能散寒温肾暖肝而止痛，治寒疝、睾丸偏坠及经寒诸痛；入脾、胃经，能温中理气而开胃止痛，治胃寒呕吐及寒凝气滞之脘腹胀痛。高良姜（E错）辛热温散，入脾、胃经。功似干姜，善温中散寒而止痛、止呕、止泻，为治中寒腹痛吐泻之要药。